附子在炮制过程中，乌头碱发生的主要化学反应是
A. 氧化反应
B. 还原反应
C. 水解反应
D. 加成反应
E. 环合反应

正确答案：C。水解反应

解析：本题考查的是附子炮制过程中的变化。附子在炮制过程中，乌头碱发生的主要化学反应是水解反应（C对）。川乌中主要毒性生物碱在炮制过程中的变化：乌头碱、次乌头碱、新乌头碱等为双酯型生物碱，具麻辣味，毒性极强，是乌头的主要毒性成分。若将双酯型生物碱在碱水中加热，或将乌头直接浸泡于水中加热，或不加热仅在水中长时间浸泡，都可水解酯基，生成单酯型生物碱或无酯键的醇胺型生物碱。如乌头碱水解后生成的单酯型生物碱为乌头次碱，无酯键的醇胺型生物碱为乌头原碱。单酯型生物碱的毒性小于双酯型生物碱，而醇胺型生物碱几乎无毒性，但它们均不减低原双酯型生物碱的疗效。这就是乌头及附子经水浸、加热等炮制后毒性变小的化学原理。